与生物地球化学性疾病的发生无关的元素是
A. P
B. I
C. Se
D. As
E. F

正确答案：A。P

解析：本题考查与生物地球化学性疾病的发生无关的元素。生物地球化学性疾病是由于地壳表面化学元素分布的不均匀性，使某些地区的水和（或）土壤中某些元素过多或过少，当地居民通过饮水、食物等途径摄入这些元素过多或过少，而引起某些特异性疾病。与生物地球化学性疾病的发生有关的元素有：碘（I）（B对）、硒（Se）（C对）、砷（As）（D对）、氟（F）（E对）。磷（P）（A错，为本题正确答案）存在于人体所有细胞中，是维持骨骼和牙齿的必要物质，几乎参与所有生理上的化学反应。磷还是使心脏有规律地跳动、维持肾脏正常机能和传达神经刺激的重要物质。